女孩，5岁。精神欠佳半个月，发热、头痛、呕吐10天。半个月前开始出现精神不佳，10天来每天发热，最高体温38.1℃，进食减少，伴头痛、呕吐。2个月前曾患“麻疹”。查体：精神差，消瘦，右眼外展受限，颈抵抗（+），Kernig征（+），Brudzinski征（+），PPD试验（-）。为明确诊断首选的检查是
A. 胸部X线片
B. 脑脊液检查
C. 血沉
D. 头颅CT
E. 脑电图

正确答案：B。脑脊液检查

解析：5岁患儿，精神欠佳半个月，发热、头痛、呕吐10天（结核性脑膜炎早期表现）。半个月前开始出现精神不佳，10天来每天发热，最高体温38.1℃，进食减少，伴头痛、呕吐（脑膜刺激期）。2个月前曾患“麻疹”（近期急性传染病史）。查体：精神差，消瘦，右眼外展受限，颈抵抗（+），Kernig征（+），Brudzinski征（+）（脑膜刺激征阳性），PPD试验（-）（结核性脑膜炎50%的患儿可呈阴性反应）。根据患者的病史、临床表现、辅助检查，目前的诊断考虑为结核性脑膜炎。脑脊液检查，是诊断颅内感染和蛛网膜下腔出血的重要依据，主要包括外观、压力、常规、生化和病理学检查。为明确诊断，该患者应首选脑脊液检查（B对）。脑电图（E错）主要适用于癫痫的诊断和分型以及精神性疾病。头颅CT（D错）用于显示病变中较明显的钙化影和出血灶，主要适用于颅内肿瘤、脑血管病、颅脑损伤等疾病。血沉（C错）检查主要对机体有无炎症，有无活动性病变等多种疾病的诊断和治疗有一定参考价值。胸部X线片（A错）适应于肺部及气道病变、心脏大血管病变、胸膜和胸壁等胸部病变疾病的辅助诊断，也可用于常规体格检查。